女，48岁。咳嗽，吐痰，咯血，杵状指，肺部听诊右肺局限性湿啰音。最可能的疾病是
A. 肺炎
B. 肺癌
C. 肺结核
D. 支气管扩张
E. 肺脓肿

正确答案：D。支气管扩张

解析：患者为中老年女性，同时出现咳痰、咯血、杵状指和肺部局限性湿啰音症状在呼吸系统疾病一般可见于支扩或者肺癌。肺部局限性啰音是由于肿块堵塞局部支气管，仅出现在肺癌早期，而杵状指则由于慢性缺氧出现在肺癌晚期，因此本例最可能的疾病是支气管扩张（D对B错）。肺炎（P46）（A错）虽然可出现咳嗽咳痰，局部啰音等，但一般不会出现杵状指。肺结核（P65）（C错）常见症状为咳嗽咳痰，1/3的患者有咯血，并且一般伴有全身症状如发热盗汗等，但是杵状指少见。肺脓肿（P58）（E错）一般全身症状严重，典型症状为大量咳痰，高热，虽然也会出现咯血，杵状指等症状，但其起病急，全身症状严重，通常啰音遍布全肺，X线可见气液平面。